在钟状期中出现的特有的细胞层并与釉质形成有关的是
A. 外釉上皮
B. 内釉上皮
C. 星网状层
D. 中间层
E. 成牙本质细胞层

正确答案：D。中间层

解析：本题考查牙胚的发生及分化。成釉器钟状期的内釉上皮和星网状层之间出现2～3层扁平细胞，称中间层（D对），并有釉质形成有关。